石棉小体是石棉肺的
A. 病理特征
B. 诊断依据
C. 接触指标
D. X线表现
E. 无意义

正确答案：C。接触指标

解析：本题考查石棉小体的相关内容。石棉小体是石棉纤维被巨噬细胞吞噬后，由一层含铁蛋白颗粒和酸性黏多糖包裹沉积于石棉纤维之上所形成的。石棉小体只能说明有过石棉接触，不能作为诊断，所以是石棉肺的接触指标（C对ABDE错）。